鳖甲的入药部位是
A. 卵鞘
B. 贝壳
C. 内壳
D. 雌虫干燥体
E. 背甲

正确答案：E。背甲

解析：本题考查的是鳖甲的来源。鳖甲的入药部位是背甲（E对）。鳖甲：【来源】为脊索动物门爬形纲鳖科动物鳖的背甲。入药部位为卵鞘（A错）的中药为桑螵蛸。桑螵蛸：【来源】为节肢动物门昆虫纲螳螂科昆虫大刀螂、小刀螂或巨斧螳螂的干燥卵鞘。入药部位为贝壳（B错）的中药为牡蛎。牡蛎：【来源】为软体动物门牡蛎科动物长牡蛎、大连湾牡蛎或近江牡蛎的贝壳。入药部位为干燥内壳（C错）的中药为海螵蛸。海螵蛸：【来源】为软体动物门乌贼科动物无针乌贼或金乌贼的干燥内壳。入药部位为雌虫干燥体（D错）的中药为土鳖虫。土鳖虫：【来源】为节肢动物门昆虫纲鳖蠊科昆虫地鳖或冀地鳖的雌虫干燥体。